下列除哪项外都是城市社区健康教育的基本作用
A. 健康教育是社区卫生服务的重要内容
B. 是促进全民健康的重要手段
C. 在社区卫生服务中具有基础作用
D. 在社区卫生服务中具有导向作用
E. 在社区卫生服务中具有引领作用

正确答案：E。在社区卫生服务中具有引领作用